固冲汤的组成药物中不含有的是
A. 白术
B. 生黄芪
C. 五味子
D. 海螵蛸
E. 山萸肉

正确答案：C。五味子

解析：该题考查固冲汤的组成。固冲汤功能固冲摄血，益气健脾，由白术、生黄芪、龙骨、牡蛎、萸肉、生杭芍 、海螵蛸、茜草、棕边炭、五倍子组成（C对）。趣记：固冲汤，总数齐，海龙母鱼要千倍——棕术芪，海龙牡萸药茜倍。